组成内囊的纤维是
A. 联络纤维
B. 连合纤维
C. 皮质传出的下行纤维
D. 传入皮质的上行纤维
E. 投射纤维

正确答案：E。投射纤维

解析：内囊是位于丘脑、尾状核和豆状核之间的白质板，分为前肢、膝、后肢三部。组成内囊的纤维均为投射纤维（E对），包括了传入皮质的上行纤维（D错）（如感觉纤维）和皮质传出的下行纤维（C错）（如运动纤维）。大脑中联络纤维（A错）为联系同侧半球内各部分皮质的纤维，连合纤维（B错）为连合左、右半球皮质的纤维，两种纤维均不是组成内囊的纤维。